在感染过程的下列表现中，最易识别的是
A. 隐性感染
B. 潜伏性感染
C. 病原体被消灭或排出体外
D. 显性感染
E. 病原携带状态

正确答案：D。显性感染

解析：除病原体被清除以外（C错），另外四种表现形式在不同传染病中各有侧重，一般来说，隐性感染最常见（A错），病原携带状态次之（E错），显性感染所占比重最低，但一旦出现，则容易识别（D对），仅少数传染病存在潜伏性感染者（B错）。